中毒型细菌性痢疾的诊断中，不强调的是
A. 反复惊厥，发生休克或呼吸衰竭
B. 病情迅速恶化
C. 急性起病伴高热
D. 大便检查异常
E. 脑膜刺激征阳性

正确答案：E。脑膜刺激征阳性

解析：中毒性菌痢起病急骤，突起畏寒、高热（C对），病势凶猛（B对），临床以严重毒血症状、休克（A对）和（或）中毒性脑病为主，确诊有赖于粪便培养（D对）。脑膜刺激征为脑膜受激惹的体征，见于脑膜炎、蛛网膜下腔出血和颅内压增高等，中毒性菌痢未必出现该体征（E错，为本题正确答案）。